下列属于黏附分子的是
A. 整合素
B. 黏蛋白样血管地址素
C. 选择素
D. 免疫球蛋白超家族
E. 以上均是

正确答案：E。以上均是